根据《城镇职工基本医疗保险用药范围管理暂行办法》，特殊适应症与急救、抢救需要时，才可以纳入基本医疗保险用药的药品是
A. 中药材
B. 中药饮片
C. 中成药
D. 血液制品
E. 口服泡腾剂

正确答案：D。血液制品

解析：本题考查的是不得纳入基本医疗保险用药范围的药品。根据《城镇职工基本医疗保险用药范围管理暂行办法》，特殊适应症与急救、抢救需要时，才可以纳入基本医疗保险用药的药品是血液制品（D对）。不得纳入基本医疗保险用药范围的药品：根据《城镇职工基本医疗保险用药范围管理暂行办法》第四条，不能纳入基本医疗保险用药范围的药品包括：①主要起营养滋补作用的药品；②部分可以入药的动物及动物脏器，干（水）果类；③用中药材（A错）和中药饮片泡制的各类酒制剂；④各类药品中的果味制剂、口服泡腾剂（E错）；⑤血液制品、蛋白类制品（特殊适应症与急救、抢救除外）；⑥劳动保障部规定基本医疗保险基金不予支付的其他药品。《城镇职工基本医疗保险用药范围管理暂行办法》第五条：《药品目录》所列药品包括西药、中成药（C错）（含民族药，下同）、中药饮片（B错）（含民族药，下同）。西药和中成药列基本医疗保险基金准予支付的药品目录，药品名称采用通用名，并标明剂型。中药饮片列基本医疗保险基金不予支付的药品目录，药品名称采用药典名。